做PPD试验后观察结果的时间为
A. 12小时内
B. 48～72小时
C. 72小时以后
D. 24～48小时
E. 12～24小时

正确答案：C。72小时以后

解析：采用自身前后对照方法，用卡介苗纯蛋白衍生物5IU在患者前臂内侧行皮内注射，分别在皮试后48h、72h观察试验结果，并将资料进行统计学处理。结果：48h与72h所判定的结核菌素试验（PPD试验）结果差异有统计学意义，P〈0.05。结论：72h判定PPD试验结果较48h阳性率高，准确性更好，因此建议临床以72h（C对）观察PPD试验的结果，以提高结果的准确性。